下列不属于康复治疗的道德要求的是
A. 理解患者
B. 同情患者
C. 关怀与帮助
D. 保守秘密和隐私
E. 联合与协作

正确答案：D。保守秘密和隐私

解析：康复治疗的伦理要求：1.理解尊重、平等相待，不论是先天或后天、疾病或外伤等所致的各种残疾，都会给残疾者带来终生、甚至难以挽回的损复治疗中，医务人员要理解与同情他们（AB对），绝不能讥笑和伤害他们的自尊，医务人员要选择效果佳而患者乐于接受的康复方法，以建立起和谐的医患关系，并促进他们尽快康复。2.热情关怀、耐心帮助（C对），残疾人行动不便，有的生活难以自理。因此，在康复治疗中，医务人员应该特别注意自身的素质、沟通方法、对患者心理感受的敏感性，要在细微之处关怀与帮助他们的生活与训练。3.合作密切、加强协作（E对），残疾人的康复，需要多学科的知识和多学科的医务人员、工程技术人员、社会工作者、特种教育工作者等人员的共同参与和努力。4.坚持公平、合理分配随着人口老龄化以及慢性病患者的增多，社会的康复需求日益增加。在健康服务体系资源不足时，应坚持公平、公正原则，避免区别对待，促进康复资源的合理化分配（D错，为本题正确答案）。